口腔颌面外科手术止血方法中，最基本、最常用的方法是
A. 压迫止血
B. 阻断止血
C. 热凝止血
D. 降压止血
E. 钳夹、结扎止血

正确答案：E。钳夹、结扎止血

解析：本题考查止血方法。口腔颌面外科手术止血方法中，最基本、最常用的方法是钳夹、结扎止血（E对）。钳夹、结扎止血即用蚊式血管钳对看得见的出血点进行迅速和准确的钳夹，浅表微小血管，钳夹即可止血，较大的出血点，配合结扎即可止血，同时不会干扰术者手术的进行，是口腔颌面外科手术止血方法中最基本、最常用的方法。压迫止血（A错）是使用外力压迫局部，使微小血管管腔闭塞达到止血目的，对于稍大的血管出血难以止住。阻断止血（B错）是临床上止血效果最明显、最可靠的方法。热凝止血（C错）是电热作用使血流凝结，可用于浅表电流凝结小血管而止血，若患者凝血功能差则止血效果差，伤口有污染者易发生感染。降压止血（D错）是在术中将收缩压降至80mmHg左右，可有效减少术中出血，但时间不宜过长，一般以30min左右，但有心血管疾病患者禁用。